“水火既济”的“水火”所指的脏是
A. 心脾
B. 肝肺
C. 脾肾
D. 心肾
E. 肝肾

正确答案：D。心肾

解析：心与肾，心火在上必须下行至肾，资助肾阳以温肾水，使肾水不寒，肾水在下必须上行至心，资助心阴以涵养心阳，使心火不亢，从而维持心肾乃至全身的水火阴阳之间的协调平衡，这种关系称之为“心肾相交”、“水火既济”（D对）。心脾、肝肺、脾肾、肝肾在五行上不符水火的属性（ABCE错）。